在黏膜局部最常见的免疫球蛋白
A. IgG
B. IgD
C. IgE
D. lgA
E. 1gM

正确答案：D。lgA

解析：本题考查各类免疫球蛋白的生物学特性和功能。在黏膜局部最常见的免疫球蛋白lgA（D对）。IgG（A错）是血清中含量最高的Ig，且是唯一能够通过胎盘进入胎儿体内的Ig，对防止新生儿感染具有重要意义。IgD（B错）占血清免疫球蛋白总量的0.2%，半衰期仅为3天。B细胞表面的膜结合型单体IgD（mIgD）为B细胞分化发育成熟的标志之一，也是BCR的组成成分。IgE（C错）是正常人血清中含量最少的Ig。IgM（E错）是发育过程中最早产生的Ig，是初次体液免疫应答中最先出现的抗体